用于治疗乙型肝炎的药物有
A. 拉米夫定
B. 恩替卡韦
C. 替比夫定
D. 阿德福韦酯
E. 替诺福韦酯

正确答案：A、B、C、D、E。拉米夫定；恩替卡韦；替比夫定；阿德福韦酯；替诺福韦酯

解析：本题考查治疗乙型肝炎的药物。用于乙型肝炎治疗的药物包括：（1）免疫调节剂：干扰素；（2）核苷类药物：如拉米夫定（A对）、替比夫定（C对）、阿德福韦（D对）、恩替卡韦（B对）、替诺福韦（E对）等。核苷（酸）类药物（NAs）是慢性乙型肝炎（CHB）患者抗病毒治疗的主要选择，具有疗效强、总体安全性和耐受性良好、服用方便等优势。干扰素是目前公认治疗慢性乙型肝炎的重要药物，具有增强清除病毒的免疫功能和直接抑制病毒的作用。